去除颈部和根面上附着的菌斑最有效的是
A. 牙线
B. 牙签
C. 含漱剂
D. 牙间刷
E. 牙龈按摩器

正确答案：D。牙间刷

解析：牙间刷适用于龈乳头丧失的邻间区，以及暴露的根分叉区和排列不整齐的牙邻面。特别是对去除颈部和根面上附着的菌斑比牙线和牙签更有效，使用起来比牙线方便。掌握“菌斑控制及提高宿主抵抗力”知识点。